基底细胞腺瘤肿瘤细胞排列成的结构不包括
A. 实性
B. 滤泡样
C. 膜性
D. 管状
E. 梁状

正确答案：B。滤泡样

解析：本题考查基底细胞腺瘤病理分类。滤泡样（B错，为本题正确答案）不属于基底细胞腺瘤的病理分类。基底细胞腺瘤是一种良性肿瘤，它以基底细胞样形态的肿瘤细胞为特征，缺乏多形性腺瘤中的黏液软骨样成分。大多数发生于腮腺，多见于60～70岁，男女之比为1：2，基底细胞腺瘤为良性肿瘤，区域切除后很少复发，来源于闰管或闰管储备细胞其病理分型主要有：1.实性型（A对）：肿瘤细胞排列成不同大小和形态的片状或岛状结构；2.小梁型（E对）：肿瘤性基底样细胞排列成小梁或条索状结构；3.膜性型（C对）：肿瘤细胞岛周围基底膜明显；4.管状型（D对）：肿瘤细胞排列成管状结构。